女，40岁。近10天内发生5次乳头血性溢液，最可能的诊断是
A. 乳腺导管扩张
B. 乳腺囊性増生
C. 乳腺癌
D. 乳腺纤维瘤
E. 导管内乳头状瘤

正确答案：E。导管内乳头状瘤

解析：40岁女性，10天内发生5次乳头血性溢液，最可能的诊断是乳管内乳头状瘤（E对）。本病好发于40～50岁的经产妇，75%的病例瘤体位于大乳管近乳头的壶腹部，瘤体通常很小，带蒂而有绒毛，且有很多薄壁的血管，容易出血，产生乳头血性溢液。乳腺导管扩张症（A错）又称浆细胞性乳腺炎（P244），为乳腺组织的无菌性炎症，局部可出现红、肿、痛等症状，部分病人在疾病早期可有一侧或双侧乳头浆液性排液。乳腺囊性增生症（P241）（B错）主要表现为乳房胀痛及肿块，仅少数病人有乳头溢液，多为浆液性或浆液血性液体。乳腺癌（C错）多表现为患侧乳房无痛性单发肿块，仅极少数病人出现血性溢液。乳腺纤维腺瘤（P242）（D错）一般仅表现为乳腺单发肿块，无乳头溢液。